预防职业中毒的根本措施是
A. 根除毒物
B. 降低生产环境中毒物浓度
C. 安全卫生管理
D. 个体防护
E. 职业卫生服务

正确答案：A。根除毒物

解析：本题考查预防职业中毒的根本措施。职业中毒的病因是生产性毒物，故预防职业中毒必须采取综合治理措施，从根本上消除、控制或尽可能减少毒物对职工的侵害。具体控制措施可概括为以下几方面：①根除毒物（A对BCDE错），这是预防职业中毒的根本措施；②降低毒物浓度，主要有以下两种途径，包括技术革新和通风排毒；③工艺、建筑布局；④个体防护；⑤职业卫生服务；⑥安全卫生管理。